血栓素A2产生的部位主要是
A. 血小板
B. 内皮细胞
C. 巨噬细胞
D. 红细胞
E. 肥大细胞

正确答案：A。血小板

解析：休克时内皮细胞（B错）的损伤，既可使PGI2 生成释放减少，也可因胶原纤维暴露，使血小板（A对）激活、黏附、聚集，生成和释放TXA 2增多。各种休克时红细胞（D错）破坏释放的ADP等可启动血小板的释放反应，促进凝血过程。长期缺血缺氧、酸中毒可刺激肥大细胞（E错）释放组胺增多。